对诊断小儿支气管哮喘最有意义的肺部体征是
A. 两肺满布哮鸣音，呼气延长
B. 双肺呼吸音减弱
C. 双下肺中细湿啰音
D. 双肺呼吸音增粗
E. 右肺中湿啰音，随体位改变

正确答案：A。两肺满布哮鸣音，呼气延长

解析：诊断小儿支气管哮喘最有意义的肺部体征是两肺满布哮鸣音，呼气延长。哮喘患儿气道的β肾上腺素能神经受体功能低下、迷走神经张力亢进及非肾上腺素能非胆碱能神经的兴奋和抑制功能失调，均可使气道反应性增高（A对）。炎症或肺气肿引起双肺呼吸音减弱（B错）。双下肺中细湿啰音，可能由肺炎或肺水肿引起（C错）。双肺呼吸音增粗提示支气管粘膜有水肿或者炎症浸润（D错）。右肺中湿啰音，随体位改变，是由左心衰引起（E错）。